备洞时的意外穿髓，露髓孔直径小于0.5mm的患牙应采用
A. 间接盖髓术
B. 直接盖髓术
C. 氢氧化钙活髓切断术
D. FC（戊二醛）断髓术
E. 根管治疗术

正确答案：B。直接盖髓术

解析：直接盖髓术：应用药物直接覆盖在露髓处，保护牙髓。应用于备洞时的意外穿髓，露髓孔直径小于0.5mm的患牙；外伤冠折露髓的患牙。龋源性露髓很少应用。掌握“乳牙牙髓病及根尖周病诊断及治疗”知识点。